某女，48岁。近期出现月经前后不定期，伴烘热出汗、眩晕耳鸣、手足心热、烦躁不安。医师诊为更年期综合征，证属肾阴虚，处以更年安片，此因该成药既能滋阴清热，又能
A. 补气养血
B. 养血调经
C. 活血止痛
D. 除烦安神
E. 养心安神

正确答案：D。除烦安神

解析：本题考查的是更年安片的功能。更年安片既能滋阴清热，又能除烦安神（D对）。更年安片：【功能】滋阴清热，除烦安神。乌鸡白凤丸：【功能】补气养血（A错），调经（B错）止带。女金丸：【功能】益气养血，理气活血，止痛（C错）。酸枣仁：【功效】养心安神（E错），敛汗。